当归四逆汤所治厥逆的机理是
A. 阳气内郁不达四末
B. 肝郁气滞
C. 心肾阳衰
D. 元气大亏阳气暴脱
E. 血虚寒凝经脉

正确答案：E。血虚寒凝经脉

解析：当归四逆汤方中当归甘温，养血和血以补虚；桂枝辛温，温经散寒以通脉，共为君药。细辛温经散寒，助桂枝温通血脉；白芍养血和营，助当归补益营血，均为臣药。通草通利经脉以畅血行；大枣、甘草，益气健脾，养血补虚，为佐药。重用大枣，既合归、芍以补营血，又防桂、辛燥烈太过，伤及阴血。甘草兼调药而为使药之用。全方共奏温经散寒，养血通脉之效（E对）。